急性胰腺炎伴脂质代谢紊乱的患者不宜静脉滴注的药物是
A. 胰岛素注射液
B. 生长抑素注射液
C. 葡萄糖注射液
D. 乌司他丁注射液
E. 脂肪乳注射液

正确答案：E。脂肪乳注射液

解析：本题考查禁忌症用药。急性胰腺炎伴脂质代谢紊乱的患者不宜静脉滴注的药物是脂肪乳注射液（E对）。急性胰腺炎伴脂质肾病、肿瘤患者不能静滴脂肪乳，其可致脂肪代谢严重紊乱，甚至死亡。